15远中邻（牙合）面窝洞，按Black窝洞分类法，应是
A. Ⅰ类洞
B. Ⅱ类洞
C. Ⅴ类洞
D. Ⅳ类洞

正确答案：B。Ⅱ类洞

解析：本题考查Black分类法。15远中邻（牙合）面窝洞，按Black窝洞分类法，应是Ⅱ类洞（B对）。按Black窝洞分类法可分为：Ⅰ类洞：所有的发育点隙裂沟的龋损所备成的窝洞（A错）。Ⅱ类洞：后牙邻面的龋损所备的窝洞，包括磨牙和前磨牙的邻面洞、邻（牙合）面洞、邻颊面洞、邻舌面洞和邻（牙合）邻洞。Ⅲ类洞：前牙邻面未累及切角的龋损所备成的窝洞。Ⅳ类洞：前牙邻面累及切角的龋损所备成的窝洞（D错）。Ⅴ类洞：所有牙齿颊（唇）舌面颈1/3处的龋损所备成的窝洞（C错）。